开放性骨折体温升高时应考虑有
A. 疼痛刺激
B. 感染
C. 休克
D. 失血
E. 组织液丢失

正确答案：B。感染

解析：发热是骨折的全身表现。骨折后一般体温正常，出血量较大的骨折血肿吸收时可出现低热，但一般不超过38℃。开放性骨折病人发生感染（B对）几率增大，可出现高热。疼痛刺激（A错）、休克（C错）、失血（D错）、组织液丢失（E错），都不会引起体温升高。